痛风病人每日脂肪的摄入量应占总能量的
A. 15%～20%
B. 20%～25%
C. 20%～30%
D. 25%～30%
E. 30%～35%

正确答案：B。20%～25%

解析：本题考查痛风病人每日脂肪的摄入量。痛风病人每日脂肪的摄入量应占总能量的20%～25%（B对ACDE错）。